甲省乙市丙县的A药品生产企业未经审查批准在丙县电视台发布虚假广告，有关机关按照行政程序对其进行处罚。如果A要申请药品广告批准文号，其广告审查机关是
A. 甲省药品监督管理部门
B. 甲省市场监督管理部门
C. 乙市药品监督管理部门
D. 乙市市场监督管理部门
E. 丙县药品监督管理部门

正确答案：A。甲省药品监督管理部门

解析：本题考查药品广告的审查部门。甲省乙市丙县的A药品生产企业未经审查批准在丙县电视台发布虚假广告，有关机关按照行政程序对其进行处罚。如果A要申请药品广告批准文号，其广告审查机关是甲省药品监督管理部门（A对）、甲省市场监督管理部门（B对）。药品广告的审查部门：国家市场监督管理总局负责组织指导药品、医疗器械、保健食品和特殊医学用途配方食品广告审查工作。各省（区、市）市场监督管理部门、药品监督管理部门（以下称广告审查机关）负责药品、医疗器械、保健食品和特殊医学用途配方食品广告审查，依法可以委托其他行政机关具体实施广告审查。